静脉血栓合并肺栓塞的栓子通常来源于
A. 下肢和骨盆深静脉
B. 心脏附壁血栓
C. 上肢静脉
D. 头颈部血管
E. 动脉粥样斑块脱落

正确答案：A。下肢和骨盆深静脉

解析：静脉血栓合并肺栓塞的栓子通常来源于下肢和骨盆深静脉（A对），偶可来源于心脏附壁血栓（B错）。动脉粥样斑块脱落（E错）形成的栓子（P57）常引起动脉系统的栓塞。